完带汤的组成成分有
A. 山药、熟地、茯苓、黄柏、知母、丹皮
B. 白芍、熟地、茯苓、黄柏、地骨皮、丹皮
C. 白芍、当归、川芎、莪术、牛膝、丹皮
D. 赤芍、猪苓、茯苓、车前子、牛膝、丹皮
E. 白芍、白术、苍术、车前子、柴胡、陈皮

正确答案：E。白芍、白术、苍术、车前子、柴胡、陈皮

解析：完带汤功能补脾疏肝，化湿止带，由人参、白术、山药、白芍、苍术、车前子、甘草、陈皮、黑芥穗、柴胡组成。方歌：完带汤中用白术，山药人参白芍辅，苍术车前黑芥穗，陈皮甘草与柴胡。（E对）。